以下有关子宫肌瘤手术指征的是
A. 腹部包块
B. 1个月妊娠子宫大
C. 近绝经年龄
D. 腹痛、腰酸
E. 继发性贫血者

正确答案：E。继发性贫血者

解析：子宫肌瘤的手术指征：1.肌瘤大于妊娠10周子宫；2.月经过多，继发贫血（E对），药物治疗无效；3.有膀胱、直肠压迫症状；4.宫颈肌瘤；5.生长迅速，可疑恶性。